下颌总义齿基托后缘应盖过磨牙后垫
A. 末端人工牙远中
B. 磨牙后垫前缘
C. 磨牙后垫的1/3～1/2
D. 磨牙后垫的1/2
E. 磨牙后垫的1/3

正确答案：D。磨牙后垫的1/2

解析：本题考查全口义齿的基托伸展范围。下颌总义齿基托后缘应盖过磨牙后垫的1/2（D对）。下颌全口义齿后缘应盖过磨牙后垫1/2～2/3，以利于义齿的边缘封闭，同时要避免压迫。磨牙后垫位置稳定，是排列人工牙时确定后牙（牙合）平面和颊舌向位置的参考标志。